免疫球蛋白的基本结构是
A. 由4条相同的重链组成
B. 由4条相同的轻链组成
C. 由二硫键相连的4条肽链组成
D. 由二硫键相连的2条肽链组成
E. 由J键连接的5条肽链组成

正确答案：C。由二硫键相连的4条肽链组成